以下对粪便无害化处理，哪项是错误的
A. 杀灭全部血吸虫卵和钩虫卵，蛔虫卵减少95%
B. 防止苍蝇滋生和繁殖
C. 粪尿混合发酵法是将人畜粪便、垃圾、杂草、污水等放在密闭的发酵池内发酵
D. 沼气发酵法可获得大量沼气和良好肥料
E. 避免污染居民区的环境

正确答案：C。粪尿混合发酵法是将人畜粪便、垃圾、杂草、污水等放在密闭的发酵池内发酵

解析：本题考查粪便无害化处理。将人畜粪便、垃圾、杂草、污水等放在密闭的发酵池内发酵（C错，为本题正确答案），这是沼气发酵法。杀灭全部血吸虫卵和钩虫卵，蛔虫卵减少95%（A对）；防止苍蝇滋生和繁殖（B对）；沼气发酵法可以获得大量沼气和良好肥料（D对）；避免污染居民区的环境（E对）均是有效的粪便无害化处理方法。